辨别寒热真假时，真象常出现于
A. 体表
B. 四肢
C. 舌脉
D. 面色
E. 以上均非

正确答案：C。舌脉

解析：一般来说，寒证多表现为寒象，热证多表现为热象，但在某些疾病的危重阶段会出现一些不符合常规的征象，也就是当疾病发展到寒极或热极的时候，有时会出现一些与其寒、热病理本质相反的“假象”，辩证时应以舌脉（C对）等表现于内部、中心的症状作为判断的主要依据，而体表（A错）、四肢（B错）、面色（D错）等外部、四肢的症状可能为假象。